不影响乳剂质量的是
A. 分层与絮凝
B. 分层与合并
C. 合并与转相
D. 破裂与转相
E. 转相与酸败

正确答案：A。分层与絮凝

解析：本题考查乳剂的稳定性。分层的主要是由于分散相和分散介质之间的密度差造成的，絮凝是可逆的，两者不影响乳剂质量（A错，为本题正确答案）。合并与破裂（BD对）为不可逆过程，会影响乳剂质量。转相（C对）是指由于某些条件的变化而改变乳剂类型的现象，能够影响乳剂质量。酸败（E对）是指其中的油、乳化剂等发生变质的现象。